体内维生素D分解代谢主要在
A. 肾脏
B. 肝脏
C. 骨骼
D. 骨骼肌
E. 肠道

正确答案：B。肝脏